心脏杂音较局限不传导的器质性病变是
A. 二尖瓣关闭不全
B. 二尖瓣狭窄
C. 主动脉瓣狭窄
D. 肺动脉瓣狭窄
E. 主动脉瓣关闭不全

正确答案：B。二尖瓣狭窄

解析：二尖瓣狭窄所致器质性杂音部位较局限（B对）。二尖瓣关闭不全（A错）杂音向左腋下传导。主动脉瓣狭窄（C错）杂音向颈部传导。肺动脉瓣狭窄（D错）时心脏杂音可向左颈部或左锁骨下区传导。主动脉瓣关闭不全（E错）杂音向胸骨左缘及心尖传导。